二巯丙醇用于解救
A. 水银中毒
B. 有机磷中毒
C. 硫酸铜中毒
D. 氰化物中毒
E. 吗啡中毒

正确答案：A。水银中毒

解析：本题考查中毒解救。二巯丙醇用于解救水银中毒（A对）。二巯丙醇用于砷、汞、金、铋及酒石酸锑钾中毒。有机磷中毒（B错）的解毒剂为阿托品、碘解磷定、氯解磷定。硫酸铜中毒（C错）可用依地酸钠等解救。氰化物中毒（D错）可用亚硝酸异戊酯、亚硝酸钠+硫代硫酸钠、亚甲蓝等解救。吗啡中毒（E错）可用纳洛酮和盐酸烯丙吗啡解救。